女婴，10个月，由母亲抱至儿童保健门诊接受常规体检。护士教其母亲抚爱孩子的方法和频率、并告知建立依恋关系和防止分离焦虑的重要性。此时护士所依据的婴幼儿期心理卫生的原则是
A. 促进运动能力
B. 促进大脑发育
C. 增进母爱
D. 母乳喂养
E. 促进智力发展

正确答案：C。增进母爱

解析：婴儿时期的心理健康，不仅影响婴儿的生长发育，对其今后的成长都有着重要的影响。1.母乳喂养的重要性（D错）。2.增进母爱（C对）：母亲的爱抚对婴儿的心理健康发展至关重要，而帮助婴儿建立依恋关系、减少分离焦虑是婴儿期心理卫生的重要内容。3.保证充足的睡眠：新生儿大脑正在快速发育之中，充足的睡眠是保证大脑发育（B错）和心理健康的重要条件。4.促进运动与智力的发展（AE错）。5.增加游戏活动。